治疗小儿病毒性心肌炎，主张大量使用的维生素是
A. 维生素A
B. 维生素B
C. 维生素C
D. 维生素D
E. 维生素E

正确答案：C。维生素C

解析：维生素C能消除氧自由基，改善心肌代谢，有助于心肌炎的恢复，100～200mg/（kg·d），加入葡萄糖20～50mL静脉注射，3～4周为一个疗程（C对）。